CTL在抗感染中主要抵御的细菌是
A. 布氏杆菌
B. 肺炎链球菌
C. 破伤风杆菌
D. 乙型链球菌
E. 金黄色葡萄球菌

正确答案：A。布氏杆菌